蛤蚧的功效有
A. 补肺气
B. 助肾阳
C. 通经络
D. 益精血
E. 定喘嗽

正确答案：A、B、D、E。补肺气；助肾阳；益精血；定喘嗽

解析：本题考查蛤蚧的功效。蛤蚧的功效有补肺气（A对）、助肾阳（B对）、益精血（D对）、定喘嗽（E对）。蛤蚧【功效】补肺气，定喘嗽，助肾阳，益精血。威灵仙【功效】祛风湿，通经络（C错），消痰水，治骨鲠。